中西药联用时，可与利尿药联用而减轻其口渴副作用的是
A. 真武汤
B. 小青龙汤
C. 桂枝汤
D. 四物汤
E. 芍药甘草汤

正确答案：A。真武汤

解析：本题考查的是中西药合理联用的例举。中西药联用时，可与利尿药联用而减轻其口渴副作用的是真武汤（A对）。木防己汤、真武汤、越婢加术汤、分消汤等与西药利尿药联用，可以增强利尿效果小青龙汤（B错）、干姜汤、柴朴汤、柴胡桂枝汤等与抗组胺药联用，可减少西药的用量和嗜睡、口渴等副作用。桂枝汤（C错）、含人参的方剂与皮质激素类药联用，可减少激素的用量和副作用。芍药甘草汤（E错）等与解痉药联用，在提高疗效的同时，还能消除腹胀、便秘等副作用。四物汤（D错）与西药联用的效果，2022年考试指南未明确说明。